执业药师资格实行注册制度，申请注册者必须同时具备的条件是
A. 取得《执业药师资格证书》
B. 遵纪守法，遵守药师职业道德
C. 身体健康，能坚持在执业药师岗位工作
D. 经所在单位考核同意
E. 学历证明

正确答案：A、B、C、D。取得《执业药师资格证书》；遵纪守法，遵守药师职业道德；身体健康，能坚持在执业药师岗位工作；经所在单位考核同意

解析：本题考查申请注册的执业药师必须具备的条件。 申请注册的执业药师，必须具备以下条件：①取得《执业药师职业资格证书》（A对）；②遵纪守法，遵守执业药师职业道德（B对），无不良信息记录；③身体健康，能坚持在执业药师岗位工作（C对）；④经执业单位考核同意（D对）。